前列腺是呈前后略扁栗子形的腺体，为重要的生殖管道附属腺，男性尿道从其实质中穿过。关于前列腺位置与功能的描述，正确的是
A. 为男性生殖腺
B. 与膀胱底相邻
C. 分泌雄性激素
D. 左、右各1
E. 有尿道通过

正确答案：E。有尿道通过

解析：男性生殖腺（A错）为睾丸，前列腺为附属腺。前列腺上端与膀胱颈（B错）、精囊腺和输精管壶腹相邻。分泌雄性激素（C错）为睾丸间质细胞。前列腺为单个（D错）的实质性器官。前列腺内有尿道通过（E对），称为尿道前列腺部。